牙槽骨垂直吸收时伴随的牙周袋多为
A. 龈袋
B. 复杂袋
C. 骨上袋
D. 骨下袋
E. 假性牙周袋

正确答案：D。骨下袋

解析：本题考查慢性牙周炎的病因，表现诊断及预后。牙槽骨垂直吸收时，在X线片上显示的是与牙根面之间形成的有一定角度的骨缺损。此时牙周袋的袋底位于牙槽嵴顶的根方（即下方），所以此种牙周袋称为骨下袋（D对）。